严禁直接服用或口含的剂型是
A. 泡腾片
B. 舌下片
C. 咀嚼片
D. 缓释片
E. 分散片

正确答案：A。泡腾片

解析：本题考查各种剂型的正确使用。服用泡腾片（A对）时应注意禁止直接服用或口含，宜用100～150ml凉开水或温水浸泡。舌下片（B错）含服时间一般控制在5min左右，含后30min内不宜吃东西或饮水。服用咀嚼片（C错）时在口腔内的咀嚼时间宜充分，咀嚼后可用少量温开水送服。服用缓释片（D错）除另有规定外，一般应整片或整丸吞服，严禁嚼碎或击碎分次服用。服用分散片（E错）时可加水分散后口服。